木香顺气丸的功能是
A. 开胃消食，润肠通便
B. 行气化湿，健脾和胃
C. 健脾开胃，行气消胀
D. 温中散寒，消食化积
E. 解表祛风，健胃消食

正确答案：B。行气化湿，健脾和胃

解析：本题考查的是木香顺气丸的功能。木香顺气丸的功能是行气化湿，健脾和胃（B对）。木香顺气丸：【功能】行气化湿，健脾和胃。功能为开胃消食，润肠通便（A错）、健脾开胃，行气消胀（C错）、温中散寒，消食化积（D错）或神曲茶功能解表祛风，健胃消食（E错）的中成药，2022年考试指南未明确说明。